女，31岁。产后5个月，哺乳期，阴道不规则流血半月余，胸闷咳嗽10天。妇科检查：宫颈前唇有一个2cm×1cm×1cm的紫蓝色结节，子宫如50天妊娠大小，质软，无压痛。双侧附件区各触及囊性包块，均约6cm×5cm×5cm大小，表面光滑。胸X线片示双肺下部多发棉絮状阴影。对诊断意义最大的辅助检查是
A. 腹部CT检查
B. 药物撤退试验
C. 胸腔镜检查
D. 血，尿常规检查
E. 血清hCG测检查

正确答案：E。血清hCG测检查

解析：该患者女，31岁，产后5个月，哺乳期，存在阴道不规则流血，胸闷咳嗽（肺转移表现）。妇科检查：宫颈前唇有一个紫蓝色结节，胸X线片示双肺下部多发棉絮状阴影（肺转移）。综合患者的症状、体征和辅助检查，初步诊断为绒癌。对诊断意义最大大的辅助检查是hCG 检测（E对），与葡萄胎相比，绒癌的B超检查不见“落雪状”与“蜂窝状”表现。腹部CT检查（A错）有助于诊断肝转移、胸腔镜检查（C错）有助于诊断肺转移有助于诊断滋养细胞肿瘤，但三者均不能区别侵蚀性葡萄胎与绒癌。药物撤退试验用于评估体内雌激素水平，以确定闭经程度（B错）。血，尿常规检查（D错）无特异性表现。